患者，女，43岁，左乳浸性导管癌术后放、化疗3年后复发，左肺门、左锁骨上、左腋窝淋巴结转移，现采用卡培它滨+多西他赛行复发后第一周期化疗，化疗后第2日患者出现重度恶心、呕吐，根据化疗药物致吐分级，宜选用的对症治疗药物是
A. 地塞米松
B. 甲氧氨普胺
C. 奥美拉唑
D. 昂丹司琼
E. 维生素B₆

正确答案：D。昂丹司琼

解析：本题考查化疗药物。根据题干宜选用的对症治疗药物是昂丹司琼（D对）。对严重呕吐或处理效果不佳者，可给予5-HT₃受体阻断剂，包括昂丹司琼、格雷司琼、雷莫司琼和托烷司琼；对轻度恶心与呕吐反应可口服多潘立酮、甲氧氯普胺（B错）进行处理，如效果不佳，可合并应用地塞米松（A错）或劳拉西泮作为补充；奥美拉唑（C错）为质子泵抑制剂，抑制胃酸分泌；维生素B₆（E错）为维生素类药，用于维生素B₆缺乏的预防和治疗，防止异烟肼中毒。